下列关于跗横关节的描述何者正确
A. 由距跟关节和距跟舟关节联合组成
B. 由距跟关节和跟骰关节联合组成
C. 其关节线内侧部凸向后，外侧部凸向前
D. 是由两个关节组成的复关节
E. 由跟骰关节和距跟舟关节联合构成

正确答案：E。由跟骰关节和距跟舟关节联合构成

解析：跗横关节由跟骰关节和跖跟舟关节联合构成（E对）。跗横关节的关节面呈S形，内侧部凸向前，外侧部凸向后（C错）。